以大肠菌群作为水污染的指示菌的原因是
A. 大肠菌群数量多，其抵抗力较病原菌弱
B. 大肠菌群的数量多，生存条件与肠道病菌相似
C. 大肠菌群数量多，生存时间较粪链球菌短
D. 与肠道病原菌的数量相一致
E. 其数量少于肠道病原菌

正确答案：B。大肠菌群的数量多，生存条件与肠道病菌相似

解析：本题考查以大肠菌群作为水污染的指示菌的原因。由于大肠菌群的数量多，而且它们的生存条件与肠道病菌相似（B对ACDE错），因此作为水污染的指示菌。